漂白粉喷撒进行室外表面（2～4小时）的常用浓度是
A. 20～40g/m²
B. 30～50g/m²
C. 40～60g/m²
D. 50～70g/m²
E. 60～80g/m²

正确答案：A。20～40g/m²

解析：本题考查漂白粉喷撒进行室外表面（2～4小时）的常用浓度。漂白粉喷撒进行室外表面（2～4小时）的常用浓度是20～40g/m²（A对BCDE错）。